下列不属于心身疾病的是
A. 精神分裂症
B. 冠心病
C. 消化性溃疡
D. 糖尿病
E. 高血压

正确答案：A。精神分裂症

解析：心身疾病指心理社会因素在疾病的发生、发展过程中起重要作用的躯体器质性疾病和躯体功能性障碍，心身疾病是并列于躯体疾病和精神疾病的第三类疾病。精神分裂症属于精神疾病，患者没有器质性病变表现（A错，为本题正确答案）。冠心病（B对）、消化性溃疡（C对）、糖尿病（D对）、高血压（E对）这些疾病均可在心理应激后起病，因情绪影响而恶化，属于心身疾病范畴。